细菌的生长繁殖方式是
A. 有丝分裂
B. 二分裂
C. 有性生殖
D. 复制
E. 断裂

正确答案：B。二分裂

解析：细菌一般以简单的二分裂法进行无性繁殖，个别细菌如结核杆菌偶有分枝繁殖的方式。掌握“细菌的生理”知识点。